大面积烧伤合并感染
A. 内源性凝血系统被激活
B. 外源性凝血系统被激活
C. 两者均有
D. 两者均无
E. 无

正确答案：C。两者均有

解析：大面积烧伤属于创伤类疾病，外源性凝血系统被激活（B对）是严重的创伤导致的组织损伤等等情况下，可释放大量组织因子入血，激活外源性凝血系统，启动凝血过程。内源性凝血系统被激活（A对，C为本题正确答案）也可出现大面积烧伤合并感染时，凝血因子Ⅻ与胶原、内毒素接触后被激活，FXII被激活为FXIla,接着再激活FXI为FXla,从而启动内源性凝血途径。。